甲状旁腺功能亢进症的实验室检查结果是
A. 高血钙、高血磷和低尿钙
B. 高血钙、低血磷和低尿钙
C. 低血钙、低血磷和高尿钙
D. 高血钙、低血磷和高尿钙
E. 低血钙、高血磷和高尿钙

正确答案：D。高血钙、低血磷和高尿钙

解析：甲旁亢时，甲状旁腺素（PTH）分泌量持续过高，可诱导破骨细胞增殖、融合、发育，以及活性增强，从而加速骨基质溶解，使骨钙、磷释放入血，导致血钙和血磷升高。升高的血钙导致原尿中Ca2+浓度过高，尽管PTH可促进肾远曲小管和集合管重吸收Ca2+，但终尿中尿钙的绝对值仍增加。此外，PTH抑制近端小管和远端小管重吸收磷，促进磷的排泄，使尿磷增加，血磷降低。综上所述，甲旁亢时血钙、血磷、尿钙的变化是高血钙、低血磷、高尿钙（D对）。